治疗流感嗜血杆菌引起的肺炎宜选用
A. 两性霉素
B. 苯唑西林
C. 利巴韦林
D. 阿奇霉素
E. 阿莫西林/克拉维酸钾

正确答案：E。阿莫西林/克拉维酸钾

解析：本题考查阿莫西林。治疗流感嗜血杆菌引起的肺炎宜选用阿莫西林/克拉维酸钾（E对）。阿莫西林为广谱的的β-内酰胺类抗生素，临床可用于流感嗜血杆菌所致的支气管炎、肺炎等，而克拉维酸钾属于β-内酰胺酶抑制剂，两者合用可产生协同作用，增强抗菌作用。两性霉素（A错）为抗真菌药。苯唑西林（B错）为β-内酰胺类抗生素。利巴韦林（C错）为抗病毒药。阿奇霉素（D错）为大环内酯类抗生素。